梅毒树胶肿为一种
A. 结缔组织
B. 淋巴组织
C. 间叶组织
D. 肉芽组织
E. 血管组织

正确答案：D。肉芽组织

解析：本题考查梅毒树胶肿。梅毒性树胶肿是三期梅毒的标志，初起为皮下深在结节性肉芽组织（D对），表面呈暗红色的浸润斑块，之后中央逐渐软化、破溃呈穿凿性，溃疡为肾形或马蹄形，边界清楚，边缘锐利，基底暗红，有黏稠树胶状脓汁流出，外观酷似阿拉伯树胶。结缔组织（A错）疾病常见于盘状红斑狼疮。淋巴组织（B错）疾病常见于良性淋巴增生性唇炎。间叶组织（C错）疾病常见于先天性外胚叶发育不全。血管组织（E错）常见于血管瘤。